位于延髓内的神经核
A. 上橄榄核
B. 上泌涎核
C. 面神经核
D. 疑核
E. 展神经核

正确答案：D。疑核

解析：位于延髓内的神经核为疑核（D对）。上泌涎核（B错）、面神经核（C错）、展神经核（E错）位于脑桥下部。上橄榄核（A错）位于脑桥中下部。